氧需是指
A. 劳动1分钟所需要的氧量
B. 1分钟内血液能供应的最大氧量
C. 劳动5分钟所需要的氧量
D. 劳动1小时所需要的氧量
E. 劳动半小时所需要的氧量

正确答案：A。劳动1分钟所需要的氧量